根据药物对不同肾上腺素受体亚型的选择性，属于α、β受体激动药的是
A. 去甲肾上腺素
B. 肾上腺素
C. 间羟胺
D. 异丙肾上腺素
E. 多巴胺

正确答案：B。肾上腺素

解析：肾上腺素（B对）属于α、β受体激动药，具有兴奋心脏、收缩血管、升高血压、舒张平滑肌、促进代谢等作用，临床可用于心脏骤停、过敏性休克、支气管哮喘等。去甲肾上腺素（A错）属于α受体激动剂，具有强大的激动作用，对β₁受体作用较弱，对β₂受体几乎无作用，临床可用于休克、药物中毒性低血压、上消化道出血等。间羟胺（C错）可直接兴奋α受体，对β₁受体作用较弱，升压作用持久，对肾血管收缩作用较NA平缓，且较少引起心律失常及少尿等不良反应。异丙肾上腺素（D错）属于经典的α、β受体激动剂，对α受体几乎无作用，临床主要用于支气管哮喘、房室传导阻滞、心脏骤停。多巴胺（E错）是去甲肾上腺素生物合成的前体，主要激动α、β受体及外周多巴胺受体，临床主要用于治疗各种休克，如心源性休克、感染性休克和出血性休克等。